男性患者，23岁，因牙齿折断前来就诊，查：牙体折断线累及牙冠与根部，斜行折裂多见，均与口腔相通，牙髓往往暴露，断裂游离部分动度大，触痛明显，则可以诊断为以下哪种牙折
A. 冠折
B. 冠折露髓
C. 根折
D. 牙冠斜折
E. 冠根联合折

正确答案：E。冠根联合折

解析：冠根折：折断线累及牙冠和根部，以斜行冠根折多见，均与口腔相通，牙髓往往暴露，患牙断片动度大，触痛明显。此占牙齿外伤的一小部分。掌握“牙折”知识点。